骑跨伤致尿道损伤的部位是
A. 前列腺部
B. 膜部
C. 球部
D. 阴茎部
E. 尿道全部

正确答案：C。球部

解析：会阴部骑跨伤时，易引起尿道球部（C对）损伤。当发生骨盆骨折时，易损伤膜部（B错），严重者可引起前列腺部（A错）损伤。阴茎部（D错）和尿道全部损伤（E错）较少见。